能综合反映外源性化学物质对机体的毒性作用，有助于发现某些毒性特征的是
A. 食物利用率
B. 脏器系数
C. 病理学检查
D. 一般性指标
E. 特异性指标

正确答案：D。一般性指标